对急性甲型和丙型肝炎有一定疗效，治疗呼吸道合胞病毒肺炎和支气管炎效果最佳的药物是
A. 利巴韦林
B. 氟康唑
C. 左氧氟沙星
D. 磺胺类药物
E. 四环素

正确答案：A。利巴韦林

解析：利巴韦林对进行甲型和丙型肝炎有一定疗效，治疗呼吸道合胞病毒肺炎和支气管炎效果最佳。掌握“氟康唑、利巴韦林及阿昔洛韦”知识点。